女，36岁。春节乘长途汽车回家途中，突然感到心前区发闷、呼吸困难、出汗，觉得自己要不行了，不能自控，要发疯，为此感到紧张、害怕，立即被送到医院急诊。未经特殊处理，半小时后症状消失。体格检查正常。该患者最可能的诊断是
A. 支气管哮喘
B. 心绞痛
C. 惊恐发作
D. 分离（转换）性障碍
E. 嗜铬细胞瘤

正确答案：C。惊恐发作

解析：该患者春节回家途中突然感到心前区发闷，呼吸困难、出汗（自主神经功能紊乱症状），不能自控，感到紧张、害怕，未经特殊处理，半小时后症状消失（终止迅速），体格检查正常，故诊断为惊恐发作（C对）。心绞痛和惊恐发作均可表现为胸闷、心悸伴有濒死感，但本例无明显诱因（过重的体力劳动），体格检查正常，故患心绞痛的可能性较小（Ｂ错），为进一步明确诊断，需借助心电图和心肌酶学检查进行排查。